《中国药典》2015年版（一部）规定，要对重金属及有害元素、有机氯农药残留量进行限量检查的药材有
A. 黄连
B. 甘草
C. 黄芪
D. 人参
E. 麦冬

正确答案：B、C。甘草；黄芪

解析：本题考查的是外源性有害物质及检测。《中国药典》2015年版（一部）规定，要对重金属及有害元素、有机氯农药残留量进行限量检查的药材有甘草（B对）与黄芪（C对）。外源性有害物质及检测：（1）重金属及有害元素：①重金属检查：矿物药如石膏、芒硝含重金属不得过10mg/kg，玄明粉不得过20mg/kg；动物药如地龙含重金属不得过30mg/kg；银杏叶提取物、黄芩提取物、连翘提取物含重金属不得过20mg/kg等。②砷盐检查：《中国药典》规定玄明粉含砷盐不得过20mg/kg，芒硝含砷盐不得过10mg/kg，石膏含砷盐不得过2mg/kg。③铅、镉、砷、汞、铜测定：《中国药典》采用原子吸收分光光度法（第一法）和电感耦合等离子体质谱法（第二法）测定中药中铅、镉、砷、汞、铜的含量，并规定甘草、黄芪、丹参、白芍、西洋参、金银花、枸杞子、山楂、阿胶、牡蛎、珍珠、蛤壳等含铅不得过5mg/kg，镉不得过0.3mg/kg，砷不得过2mg/kg，汞不得过0.2mg/kg，铜不得过20mg/kg。海螵蛸含铅不得过5mg/kg，镉不得过5mg/kg，砷不得过10mg/kg，汞不得过0.2mg/kg，铜不得过20mg/kg。（2）农药残留量：《中国药典》规定，人参（D错）和西洋参中含五氯硝基苯不得过0.1mg/kg，六氯苯不得过0.1mg/kg，七氯（七氯、环氧七氯之和）不得过0.05mg/kg ，氯丹（顺式氯丹、反式氯丹、氧化氯丹之和）不得过0.1mg/kg；甘草和黄芪中含五氯硝基苯不得过0.1mg/kg 。